结构与β受体拮抗剂相似，具有轻度β受体拮抗作用的抗心律失常的药物是
A. 盐酸普鲁卡因胺
B. 盐酸利多卡因
C. 盐酸普罗帕酮
D. 奎尼丁
E. 盐酸美西律

正确答案：C。盐酸普罗帕酮

解析：本题考查普罗帕酮。普罗帕酮（C对）是ⅠC类抗心律失常药，结构与β受体拮抗剂相似，具有轻度β受体拮抗作用。盐酸普鲁卡因胺（A错）结构为对氨基苯甲酰胺。盐酸利多卡因（B错）结构中含酰胺，与β受体拮抗剂不同。奎尼丁（D错）是生物碱类药物。盐酸美西律（E错）是将利多卡因中的酰胺键替换为醚键。